1986年国际移植学会发布的“分配尸体器官的准则”不包括的内容是
A. 将所收集的捐赠器官给以最佳利用
B. 依据医学标准将器官给以最合适移植的病人
C. 必须经由国家或地区的器官分配网分配器官
D. 参与移植医生不应从事该类宣传
E. 不可付钱给捐赠者，但补偿其因手术和住院等所付出的开支和损失是可以的

正确答案：E。不可付钱给捐赠者，但补偿其因手术和住院等所付出的开支和损失是可以的

解析：不可付钱给捐赠者，但补偿其因手术和住院等所付出的开支和损失是可以的（E错，为本题正确答案），不属于分配尸体器官的准则。“分配尸体器官的准则”包括：（1）最优化原则，将所收集的捐赠器官给以最佳利用（A对）；依据医学标准将器官给以最合适移植的病人（B对）；决不可以浪费可供使用的器官；（2）公正分配原则，应成立区域性或全国性的器官分配网，做公平合适的分配，必须经由国家或地区的器官分配网分配器官（C对）；（3）参与移植医生不应从事该类宣传（D对）。